成人牙齿松动，过早脱落的最主要原因是
A. 肾阳虚
B. 肾阴虚
C. 脾气虚
D. 肾精亏
E. 脾阳虚

正确答案：D。肾精亏

解析：本题考查的是肾与体的关系。成人牙齿松动，过早脱落的最主要原因是肾精亏（D对）。肾在体合骨：骨，即骨骼。骨是人体的支架，并有保护内脏等作用。肾主骨，是说骨的生长发育及其功能的发挥，均依赖于肾中精气的充养。“齿为骨之余”，牙齿是全身最硬的骨组织，牙齿的生长与脱落，与肾中精气的盛衰密切相关。所以牙齿与骨同属肾所主。肾精亏虚，则骨失所养而痿弱，易于骨折，牙齿松动而脱落。肾阳虚（A错）证的临床表现，常见形寒肢冷，精神不振，腰膝酸软，或阳痿不举，舌淡苔白，脉沉迟或两尺无力。肾阴虚（B错）证的临床表现，常见头晕目眩，耳鸣耳聋，牙齿松动，失眠遗精，口燥咽干，五心烦热，盗汗，腰膝酸痛，舌红，脉细数。脾气虚（C错）：由于素体虚弱，劳倦与饮食不节等，内伤脾气，以致脾气虚弱。临床上常见脾虚证候可分三类：（1）脾失健运证：临床表现常见食纳减少，食后作胀，或肢体浮肿，小便不利，或大便溏泻，时息时发，并伴有身倦无力、气短懒言、面色萎黄、舌质淡嫩、苔白、脉缓弱。（2）脾虚下陷证：临床表现常见子宫脱垂，脱肛，胃下垂，慢性腹泻，并见食纳减少，食后作胀，少腹下坠，体倦少气，气短懒言，面色萎黄，舌淡苔白，脉虚。（3）脾不统血证：临床表现常见面色苍白或萎黄，饮食减少，倦怠无力，气短，肌衄，便血以及妇女月经过多，或崩漏，舌质淡，脉细弱。脾阳虚（E错）证的临床表现，常见在脾失健运症状的基础上，同时出现腹中冷痛，腹满时减，得温则舒，口泛清水，四肢不温，气怯形寒，脉沉迟而舌淡苔白。妇女则见白带清稀，小腹下坠，腰酸沉等症。